化生元气的主要是
A. 肾中精气
B. 水谷之气
C. 元气
D. 宗气
E. 脏腑之气.

正确答案：A。肾中精气

解析：元气是由肾中精气化生，跟于命门，是人体最根本、最重要的气（A对）。水谷之气即饮食的精气，不是元气化生的主要物质（B错）；宗气是积于胸中之气，不是元气化生的主要物质（C错）；脏腑之气是全身之气的组成部分，不是元气化生的主要物质（E错）。